男，68岁，2周来反复胸痛，发作与劳累及情绪有关，休息可以缓解。3小时前出现持续性疼痛，进行性加剧，并气促，不能平卧，血压110/70mmHg，心率120次/分，律齐，心尖部可闻及Ⅲ级收缩期杂音，双肺散在哮鸣音及湿性啰音下列何种治疗方案应首选
A. β-受体阻滞剂预防室性心律失常
B. 抗生素控制感染
C. 洋地黄类药物治疗
D. 肾上腺皮质激素减轻支气管痉挛
E. 吗啡和利尿剂治疗

正确答案：E。吗啡和利尿剂治疗

解析：患者老年男性，2周来反复胸痛，发作与劳累及情绪有关，休息可缓解，提示稳定型心绞痛。3小时前出现持续性疼痛，进行性加剧，并气促，不能平卧，血压偏低，心率快而齐，提示发生急性心肌梗死，心尖部可闻及Ⅲ级收缩期杂音（乳头肌功能失调引起），双肺散在哮鸣音及湿性啰音提示急性左心衰竭引起肺水肿。因此本患者考虑诊断为急性心肌梗死伴急性左心衰竭。吗啡可解除心肌梗死引起的持续性疼痛，也可使患者镇静，减轻心脏负担，同时舒张小血管减轻心脏负荷，利尿剂可减少体液潴留，同时扩张静脉，有利于肺水肿缓解。因此治疗方案应首选吗啡和利尿剂治疗（E对）。β受体阻滞剂禁用于重度急性心力衰竭患者（P172），故不宜作为本例首选（A错）。本例并无肺部感染症状，因此无需抗生素控制感染（B错）。洋地黄类药物（C错）主要用于慢性心力衰竭的强心治疗，当急性心肌梗死导致心力衰竭时，洋地黄因可能引起室性心律失常而慎用，需要注意的是心肌梗死发生后24小时内宜尽量避免使用洋地黄制剂（P244）。肾上腺皮质激素减轻支气管痉挛（D错）一般用于哮喘的治疗（P32）。